男，60岁。因胃溃疡合并多次大出血，行胃大部切除术。该病人术后可能出现的营养性并发症不包括
A. 体重减轻
B. 溶血性贫血
C. 腹泻
D. 脂肪泻
E. 骨病

正确答案：B。溶血性贫血

解析：胃大部切除术后，胃容量减少，容易出现饱胀感，使能量摄入不足，可有腹泻（C对），出现体重下降（A对）。胃大部切除后，壁细胞减少，内因子分泌减少，维生素B₁₂吸收障碍，易导致巨幼细胞性贫血，也可因胃酸分泌不足且食物快速进入空肠，绕过铁的主要吸收部位（十二指肠），使铁吸收减少，造成缺铁性贫血（B错，为本题正确答案）。胃大部切除术后，胃内食物直接进入上段空肠，食物不能与胰液、胆汁很好的混合，发挥胰酶与胆汁的功能，影响脂肪吸收，造成脂肪泻（D对）。胃大部切除术后，约1/3的病人有钙磷代谢紊乱，出现骨质疏松、骨软化等骨病（E对）。